用药后2小时内尽量不排尿或局部冲洗的剂型是
A. 咀嚼片
B. 舌下片
C. 泡腾片
D. 阴道栓
E. 控释片

正确答案：D。阴道栓

解析：本题考查各种剂型的正确使用。阴道栓（D对）在给药后1～2h内尽量不排尿，以免影响药效。咀嚼片（A错）在口腔内的咀嚼时间宜充分，咀嚼后可用少量温开水送服。舌下片（B错）含服时间一般控制在5min左右，含后30min内不宜吃东西或饮水。泡腾片（C错）一般宜用100～150ml凉开水或温水浸泡，可迅速崩解和释放药物，严禁直接服用或口含。服用缓、控释制剂的药片（E错）或胶囊时，除另有规定外，一般应整片或整丸吞服，严禁嚼碎和击碎分次服用。